抗血小板药西洛他唑属于
A. 维生素K拮抗剂
B. 二磷酸腺苷P2Y12受体阻断剂
C. 整合素受体阻断剂
D. 磷酸二酯酶抑制剂
E. 直接凝血酶抑制剂

正确答案：D。磷酸二酯酶抑制剂

解析：本题考查西洛他唑。抗血小板药西洛他唑属于磷酸二脂酶抑制剂（D对），通过抑制磷酸二酯酶活性使血小板内环磷酸腺苷（cAMP）浓度上升，抑制血小板聚集。维生素K拮抗剂（A错）有华法林。二磷酸腺苷（ADP）P2Y12受体阻断剂（B错）分为噻吩并吡啶类和非噻吩并吡啶类。整合素受体阻断剂（C错）代表药物替罗非班。直接凝血酶抑制剂（E错）有达比加群酯。